男性，74岁，体重60Kg，全胃切除术后5天，大量肠液自腹腔引流管引出，左上腹疼痛，查体，左上腹轻压痛，无肌紧张。该病人热量每天基本要求量是
A. 800kal
B. 1200kcal
C. 1500kal
D. 2000kcal
E. 2500kcal

正确答案：D。2000kcal

解析：此题为老题目，但按照九版外科书（P100）数据进行计算。本例患者全胃切除术后一般情况良好，正常机体热量每天基本需要量25-30kcal/kg，但择期手术约增加10%左右，可知此病人每天的热量需要量为1650-1980kcal（D对）。